目前国际通用的反映个体营养状况的评价方法是
A. 身高体重指数
B. 身高坐高指数
C. 身高胸围指数
D. 年龄别体重
E. 身高标准体重

正确答案：E。身高标准体重

解析：本题考查营养状况的评价方法。身高标准体重（E对ABCD错）是目前国际评价人体形态发育水平和营养状况及身体匀称度的重要指标。身高标准体重是指身高与体重两者的比例应在正常的范围。它通过身高与体重一定的比例关系，反映人体的围度、宽度和厚度以及密度。